初孕妇，孕31周。双下肢浮肿20天，既往无特殊。查体：BP18/12kp（135/90mmHg），尿蛋白定量2g/24h，诊断是
A. 轻度妊娠高血压综合征
B. 中度妊娠高血压综合征
C. 子痫
D. 先兆子痫
E. 妊娠合并肾炎

正确答案：A。轻度妊娠高血压综合征

解析：本例患者为初孕妇，孕31周，双下肢浮肿，血压135/90mmHg（舒张压≥90mmHg），尿蛋白定量2g/24h（≥0.3g/24h），根据患者临床表现和实验室检查结果，诊断是子痫前期。轻度妊娠高血压综合征（A对）主要表现为血压轻度升高，即妊娠20周后血压升高达130/90mmHg以上，可能伴有轻度水肿和微量蛋白尿。此阶段持续数日至数周，可逐渐发展或迅速恶化。中度妊娠高血压综合征（B错）表现为血压进一步升高，但不超过160/110mmHg，尿蛋白增加，伴有水肿，可有头晕等轻度自觉症状。重度妊娠高血压综合征，包括先兆子痫（D错）及子痫（C错），血压超过160/110mmHg，尿蛋白+～+++以上，水肿程度不等，出现头痛、眼花等自觉症状，严重者抽搐、昏迷。妊娠合并肾炎（E错）多有肾炎病史，除程度不等的蛋白尿、水肿、高血压，常有贫血和肾功能不全的表现。根据九版妇产科学（已经取消妊娠高血压综合征轻、中、重的分级）
本题无正确答案。